能够引起轻、中、重、极重骨髓型外照射急性放射病的吸收剂量范围为
A. 1.0～10.0Gy
B. 10.0～20.0Gy
C. 20.0～30.0Gy
D. 30.0～40.0Gy
E. 40.0～50.0Gy

正确答案：A。1.0～10.0Gy

解析：本题考查能够引起轻、中、重、极重骨髓型外照射急性放射病的吸收剂量范围。当吸收剂量在1.0～10.0Gy时（A对BCDE错），暴露者会出现轻、中、重、极重骨髓型外照射急性放射病，主要有乏力、头晕、失眠、食欲下降、恶心呕吐、毛发脱落等症状。